某省药品监督管理部门在对辖区内药品批发企业甲（经营范围不包括中药饮片）实施监督检查时，发现甲的仓库储存作业区内存放有约2000套印有生产企业名称的为邻省中药饮片生产企业乙的中药饮片包装袋，以及已完成包装待封口的500余袋印有生产企业名称的为乙的疑似“中药饮片”半成品，现场有加工中药材的痕迹。甲的采购人员交代，加工“中药饮片”的原料药材系采购自本省中药材专业市场商户丙的中药材初加工产品，经仓库养护员直接套袋完成包装；甲的销售人员交代，约有20袋上述“中药饮片”成品销售给了本省药品零售企业丁。就有关情况，甲所在地省级药品监督管理部门与邻省药品监督管理部门进行了沟通。经邻省药品监督管理部门协查确认，乙确实存在向甲有偿提供其中药饮片包装袋的行为。结合题目提供的信息，以下说法错误的是
A. 乙明知甲从事非法药品生产行为，依然为其提供便利条件，构成共犯
B. 丁应当对采购自甲处的20袋“中药饮片”中已售出的部分发起追回
C. 甲分装“中药饮片”的行为违反《药品经营质量管理规范》
D. 由于甲依法持有《药品经营许可证》，丁从其处购买饮片不构成从非法渠道购进药品情形

正确答案：D。由于甲依法持有《药品经营许可证》，丁从其处购买饮片不构成从非法渠道购进药品情形

解析：本题考查药品经营企业计算机系统的主要规范内容。说法错误的是由于甲依法持有《药品经营许可证》，丁从其处购买饮片不构成从非法渠道购进药品情形（D错，为本题正确答案）。药品批发企业销售药品时，系统应当依据质量管理基础数据及库存记录生成销售订单，系统拒绝无质量管理基础数据或无有效库存数据支持的任何销售订单的生成。系统对各购货单位的法定资质能够自动识别并审核，防止超出经营方式或经营范围的销售行为的发生。药品经营类别：药品经营类别是药品零售企业《药品经营许可证》载明事项之一，具体分为：处方药、甲类非处方药、乙类非处方药。从事药品零售审批时，药品监督管理部门应当先核定经营类别，并在经营范围中予以明确（A对）。根据监督检查情况，有证据证明可能存在药品安全隐患的，药品监督管理部门应当依法采取发布告诫信、启动责任约谈、责令限期整改、责令暂停药品销售和使用、责令召回或者追回等风险防控措施（B对）。药品经营质量管理规范总体要求：药品GSP是为保证药品在流通全过程中始终符合质量标准，依据《药品管理法》等法律法规制定的针对药品采购、购进验收、储存运输、销售及售后服务等环节的质量管理规范，其核心是要求企业通过严格的质量管理制度来约束自身经营相关行为，对药品流通全过程进行质量控制。药品上市许可持有人、药品经营企业应当严格执行药品GSP，依法从事药品经营活动，不得采取任传虚假欺骗行为，在药品采购、储存、销售、运输等环节采取有效的质量控制措施，确保药品质量，并按照国家有关要求，建立药品追溯体系，实现药品可追溯（C对）。